男，40岁。间断发热、腹泻3个月。体温最高达38.8℃，腹泻4~6次/日，水样便，体重下降5kg，有静脉吸毒史。查体：T38.6℃，消瘦，肺部未闻及干湿性啰音，腹软，无明显压痛及反跳痛，肝脾肋下未触及。最可能的诊断是
A. 慢性阿米巴痢疾
B. 艾滋病
C. 溃疡性结肠炎
D. 慢性细菌性痢疾
E. 肠结核

正确答案：B。艾滋病

解析：患者中年男性，有静脉吸毒史（艾滋病传染重要途径），近3月间断发热、腹泻、体重下降明显，无其余明显特征，结合患者病史，临床表现，考虑诊断为艾滋病（B对）；艾滋病期。慢性阿米巴痢疾（A错）多由急性阿米巴疾病迁延而来，主要表现为腹胀、腹泻胃肠不适症状，及贫血、乏力等全身症状。粪便检查有滋养体和包囊可明确诊断。腹泻时为黏液血性或血水样便（P263）。慢性细菌性痢疾（D错）由急性菌痢迁延而来，除腹痛腹泻，粘液脓血便等典型表现外，多伴有营养不良、贫血、乏力等全身症状（P184）。溃疡性结肠炎（C错）典型临床表现为腹痛、反复发作的腹泻、粘液脓血便。肠结核（E错）在累及回肠末端时，可出现腹泻，糊样便。